扩张冠状血管作用强，可解除冠状痉挛，对变异性心绞痛效果好的药物是
A. 硝酸甘油
B. 普萘洛尔
C. 双嘧达莫
D. 硝苯地平
E. 曲美他嗪

正确答案：D。硝苯地平

解析：本题考查硝苯地平。扩张冠状血管作用强，可解除冠状痉挛，对变异性心绞痛效果好的药物是硝苯地平（D对）。硝苯地平是第一代二氢吡啶类的短效钙通道阻滞药，对冠脉的痉挛作用显著，故对变异型心绞痛最有效，伴高血压或窦性心动过缓的患者尤为适用；亦可用于慢性稳定型心绞痛和不稳定型心绞痛的防治。硝酸甘油（A错）通过降低心肌耗氧量、舒张冠状动脉、增加缺血区血液灌注可用于治疗各种类型心绞痛（包括劳累型心绞痛、变异型心绞痛以及不稳定型心绞痛）。普萘洛尔（B错）可治疗稳定型及不稳定型心绞痛，可减少发作次数，对兼患高血压或心律失常者更为适用。双嘧达莫（C错）主要用于防治血栓形成。曲美他嗪（E错）主要用于心绞痛发作的预防性治疗,也可以用于眩晕和耳鸣的辅助性对症治疗。